引起牙周脓肿的常见菌是
A. 产气荚膜梭菌
B. 破伤风梭菌
C. 无芽胞厌氧菌
D. 肉毒杆菌
E. 艰难梭菌

正确答案：C。无芽胞厌氧菌

解析：本题考查引起牙周脓肿的常见菌。引起牙周脓肿的常见菌是无芽胞厌氧菌（C对）。齿槽脓肿、下颌骨髓炎、急性坏死性溃疡性牙龈炎（奋森咽峡炎）和约30％的牙周病主要由无芽胞厌氧革兰阴性杆菌引起。产气荚膜梭菌（A错）能产生多种外毒素，其中α毒素毒性最强最重要，可造成细胞溶解，所致疾病包括气性坏疽、食物中毒等。破伤风梭菌（B错）是破伤风的病原菌，可产生破伤风溶血毒素和破伤风痉挛毒素2种外毒素，后者属于神经毒素，可作用于神经系统，引起痉挛性麻痹。肉毒杆菌（D错）主要存在于土壤中，在厌氧环境下能产生毒性极强的肉毒毒素，其作用于外周胆碱能神经，抑制神经肌肉接点处神经介质乙酰胆碱的释放，导致迟缓性麻痹，所致疾病包括食物中毒、婴儿肉毒病及创伤感染中毒。艰难梭菌（E错）是人类肠道中正常菌群之一，当患者长期使用或不规范使用某些抗生素以后，可引起肠道内的菌群失调，耐药的艰难梭菌可产生肠毒素和细胞毒素，可导致抗生素相关性腹泻和家模型结肠炎等疾病。